心理障碍患者躯体症状的产生是由于心理必须通过生理的中介才能产生的，持这种观点的学者是
A. 罗杰斯
B. 坎农
C. 巴甫洛夫
D. 华生
E. 弗洛伊德

正确答案：B。坎农

解析：坎农认为情绪产生的中心不在外周系统，而在中枢神经系统的丘脑。坎农认为由外界刺激引起感官的神经冲动，通过感觉神经传至丘脑，再由丘脑同时向上向下发出神经 冲动，向上传到大脑产生情绪的主观体验，向下传至交感神经引起机体的生理变化。因而，坎农的学说表面，心理障碍患者躯体症状的产生必须通过生理的中介（B对）。罗杰斯是人本主义心理治疗流派中最有影响的人，创立了以人为中心的治疗，他认为每个人都有自己的主观世界，都存在于以他自己为中心的不断改变的体验世界中（A错）。巴甫洛夫提出了情绪的动力定型和高级神经活动学说，认为高级神经活动控制情绪并调节内脏功能，并进一步推论，高级神经活动的异常可导致内脏功能失调，使机体产生各种各样的疾病（C错）。华生创立了行为主义理论，行为学习的理论来源主要有三个方面：经典条件反射理论、操作性条件反射理论、社会学习理论（D错）。弗洛伊德创立的精神分析疗法是指在精神分析理论的指导下，治疗者运用自由联想、释梦、移情与反移情分析、阐释等技术，发现病人压抑在潜意识中的冲突，使病人领悟到心理问题的潜意识症结，让焦虑的情绪得到宣泄，从而使其能以现实的方式处理和适应各种情况（E错）。